处理头部创伤时，必须遵循的外科原则是
A. 头皮下出血点必须一一结扎
B. 尽量切除可能污染的头皮创缘组织
C. 伤口一律全层缝合
D. 大块的头皮缺损只能留作二期处理
E. 清创术应争取在8小时内进行，一般不得超过24小时

正确答案：E。清创术应争取在8小时内进行，一般不得超过24小时

解析：头部创伤的主要处理原则为：清创术应争取在6～8小时内进行，一般不得超过24小时（E对）；术中应将头皮内的毛发、泥沙等异物彻底清除，明显挫伤污染的创缘应切除，可能污染的头皮创缘组织可保留（B错），以免切除过多，缝合时产生张力；头部血供丰富，头皮下出血量较大的出血点可予以结扎止血，但不必一一结扎（A错）；损伤的类型不同，头皮缝合的深度不同，如为浅层的头皮裂伤，皮层缝合即可，而严重的头皮撕脱伤则需全层缝合（C错）；大块的头皮缺损，如缺损完整、断端整齐、无明显污染，且伤后未超过6小时者，可清创后一期缝合，污染较重或缺损组织坏死者，行创面清洁和更换敷料后，留作二期处理（D错）等。